最常用的免疫炎症反应的抑制药物为
A. 环孢菌素
B. 糖皮质激素
C. 单克隆抗体
D. 生长因子
E. 胸腺肽

正确答案：B。糖皮质激素

解析：糖皮质激素是临床最常用的免疫抑制剂，有强大的免疫抑制作用。掌握“常见口腔自身免疫性疾病及自身免疫性疾病的治疗”知识点。